采用根尖片分角线投照技术显示被检查牙齿邻面影像重叠的原因
A. 投照垂直角度过大
B. 投照垂直角度过小
C. X线与被检查牙齿的邻面不平行
D. X线与被检查牙齿的邻面不垂直
E. X线中心线位置不正确

正确答案：C。X线与被检查牙齿的邻面不平行

解析：本题考查X线中心线角度与位置对影像的影响。X线与被检查牙的邻面不平行（C对）时，根尖片分角线投照技术显示被检查牙齿邻面影像重叠。X线与被检查牙齿的邻面不垂直（D错）并且平行时，不会导致影像重叠。投照垂直角度过大（A错）时，图像牙的长度小于实际牙的长度；投照垂直角度过小（B错）时，图像牙的长度大于实际牙的长度。X线中心线位置不正确（E错）时，拍摄出来的图像不清晰。